早期佝偻病的实验室检查指标下降是
A. 血钙
B. 血磷
C. 血清25-（OH）D3
D. 碱性磷酸酶
E. 甲状旁腺素

正确答案：C。血清25-（OH）D3

解析：在佝偻病早期的实验室检查指标中，血清25-（OH）D3下降（C对）。